BUN的正常值是
A. 90～420μmol/L
B. 2.86～7.10mmol/L
C. 44～133μmol/L
D. 18～33mg/dl
E. 3.5～5.3mmol/L

正确答案：B。2.86～7.10mmol/L

解析：本题考查口外一般检查及辅助检查。BUN的正常值是2.86～7.10mmol/L（B对）。尿素氮的正常指标为：2.86～7.14mmol/L，这是我们定义上的正常值，一旦超出这个范围，我们就是尿素氮偏高。